2016年8月，全国卫生与健康大会指出要坚持中国特色卫生与健康发展道路，要把（）放在优先发展的战略地位
A. 经济效益
B. 社会利益
C. 文化传承
D. 人民健康
E. 企业发展

正确答案：D。人民健康